受何种细菌污染的化妆品进入眼内会引起角膜化脓性溃疡
A. 金黄色葡萄球菌
B. 铜绿假单胞菌
C. 粪大肠菌群
D. 变形杆菌
E. 荧光假单胞杆菌

正确答案：B。铜绿假单胞菌